在突发环境污染事件即将发生或已经发生的紧急状态下，Ⅰ级应急响应由下列哪些部门组织实施
A. 国家环境保护部和国务院有关部门
B. 国家环境保护部和国家公安部
C. 国家环境保护部和省级环保局
D. 国家环境保护部和省人民政府
E. 省级人民政府以及省级环保局

正确答案：A。国家环境保护部和国务院有关部门

解析：本题考查Ⅰ级应急响应的组织实施部门。在突发环境污染事件即将发生或已经发生的紧急状态下，Ⅰ级应急响应由国家环境保护部和国务院有关部门（A对BCDE错）组织实施。